吗啡的适应证是
A. 分娩止痛
B. 支气管哮喘
C. 心源性哮喘
D. 颅脑外伤止痛
E. 感染性腹泻

正确答案：C。心源性哮喘

解析：吗啡的适应证是：①镇痛：有强的镇痛作用，对持续性钝痛比间断性锐痛及内脏绞痛效果强。1次给药，镇痛作用持续4～8小时，故仅用于创伤、手术、烧伤、心肌梗塞等引起的剧痛。②镇静：在镇痛的同时有明显镇静作用，有时产生欣快感，可改善疼痛病人的紧张情绪。③抑制呼吸：可抑制呼吸中枢，降低呼吸中枢对二氧化碳的敏感性。④镇咳：可抑制咳嗽中枢，产生镇咳作用。因有成瘾性，并不适用于临床。⑤对平滑肌的作用：可使消化道平滑肌兴奋，致使便秘；并使胆道、输尿管、支气管平滑肌张力增加。⑥心血管系统：可促进内源性组胺的释放而使外周血管扩张、血压下降；使脑血管扩张，颅压增高。⑦镇吐：亦因有成瘾性而不适用于临床。掌握“吗啡、哌替啶”知识点。